在某地进行的吸烟与肺癌关系的研究显示，该地人群肺癌年死亡率为0.56‰，吸烟与不吸烟者的肺癌年死亡率分别为0.96‰和0.07‰。上述研究的特异危险度（AR）为
A. 0.04‰
B. 0.89‰
C. 92.7‰
D. 87.5‰
E. 0.49‰

正确答案：B。0.89‰